有关痈处理方法错误的是
A. 中央部坏死组织多，全身症状重者，应手术治疗
B. 切口应超出炎症范围
C. 切开至皮肤全层
D. 尽量剪除坏死组织
E. 唇痈不宜切开

正确答案：C。切开至皮肤全层

解析：痈是由金黄色葡萄球菌感染引起的多个相邻的毛囊及其周围组织同时发生急性细菌性化脓性炎症。中央部坏死组织多，全身症状重者，应及时手术，以免病变继续扩大加重引发脓毒症（A对）；切开引流时，切口线应超出病变边缘皮肤（B对），清除已化脓和尚未化脓、但已失活的组织（D对）。局部处理中，切口应深达筋膜或筋膜下，而不能切开皮肤全层（C错，为本题正确答案），否则容易导致浅组织的化脓性感染细菌入血而引发脓毒症加重病情。唇痈对人体危害性很大，切开后易导致化脓性海绵状静脉窦炎（E对）。